某零售药店的下列行为，符合药品经营质量管理规范的有
A. 购销记录的药品名称填写为药品商品名
B. 对每批入库、出库的药品都有检查记录
C. 药师拒绝调配含有配伍禁忌的民间处方
D. 抗生素与维生素C摆放在同一柜台
E. 聘请药学专业本科毕业生为质量管理人员

正确答案：B、C、E。对每批入库、出库的药品都有检查记录；药师拒绝调配含有配伍禁忌的民间处方；聘请药学专业本科毕业生为质量管理人员

解析：本题考查的是药品零售企业经营质量管理规范。某零售药店的下列行为，符合药品经营质量管理规范的有对每批入库、出库的药品都有检查记录（B对）；药师拒绝调配含有配伍禁忌的民间处方（C对）；聘请药学专业本科毕业生为质量管理人员（E对）。药品零售企业质量管理、验收、采购人员：具有药学或者医学、生物、化学等相关专业学历或者具有药学专业技术职称。药品零售企业操作规程和相关记录的建立与保存：药品零售操作规程应当包括：药品采购、验收、销售；处方审核、调配、核对；中药饮片处方审核、调配、核对；药品拆零销售；特殊管理的药品和国家有专门管理要求的药品的销售；营业场所药品陈列及检查；营业场所冷藏药品的存放；计算机系统的操作和管理；设置库房的还应当包括储存和养护的操作规程。企业应当建立药品采购、验收、销售、陈列检查、温湿度监测、不合格药品处理等相关记录，做到真实、完整、准确、有效和可追溯。记录及相关凭证应当至少保存5年。特殊管理的药品的记录及凭证按相关规定保存。通过计算机系统记录数据时，相关岗位人员应当按照操作规程，通过授权及密码登录计算机系统，进行数据的录入，保证数据原始、真实、准确、安全和可追溯。电子记录数据应当以安全、可靠方式定期备份。药品零售企业药品销售管理：销售药品应当符合以下要求：处方经执业药师审核后方可调配；对处方所列药品不得擅自更改或者代用，对有配伍禁忌或者超剂量的处方，应当拒绝调配，但经处方医师更正或者重新签字确认的，可以调配；调配处方后经过核对方可销售；处方审核、调配、核对人员应当在处方上签字或者盖章，并按照有关规定保存处方或者其复印件；销售近效期药品应当向个人消费者告知有效期；销售中药饮片做到计量准确，并告知煎服方法及注意事项；提供中药饮片代煎服务，应当符合国家有关规定。企业销售药品应当开具销售凭证，内容包括药品名称、生产厂商、数量、价格、批号、规格等，并做好销售记录。药品在售出时，应当执行追溯体系的规定。《中华人民共和国药品管理法》第五章药品经营第五十七条：药品经营企业购销药品，应当有真实、完整的购销记录。购销记录应当注明药品的通用名称（A错）、剂型、规格、产品批号、有效期、上市许可持有人、生产企业、购销单位、购销数量、购销价格、购销日期及国务院药品监督管理部门规定的其他内容。药品零售企业药品陈列要求：药品的陈列应当符合以下要求：按剂型、用途以及储存要求分类陈列，并设置醒目标志，类别标签字迹清晰、放置准确；药品放置于货架（柜），摆放整齐有序，避免阳光直射；处方药、非处方药分区陈列（D错），并有处方药、非处方药专用标识；处方药不得采用开架自选的方式陈列和销售；外用药与其他药品分开摆放；拆零销售的药品集中存放于拆零专柜或者专区；第二类精神药品、毒性中药品种和罂粟壳不得陈列；冷藏药品放置在冷藏设备中，按规定对温度进行监测和记录，并保证存放温度符合要求；中药饮片柜斗谱的书写应当正名正字；装斗前应当复核，防止错斗、串斗；应当定期清斗，防止饮片生虫、发霉、变质；不同批号的饮片装斗前应当清斗并记录；经营非药品应当设置专区，与药品区域明显隔离，并有醒目标志。